《医疗机构管理条例》规定，医疗机构不得使用非卫生技术人员从事
A. 医疗后勤服务工作
B. 医疗卫生技术工作
C. 医院安全保卫工作
D. 医院财务审计工作
E. 医疗器械采购工作

正确答案：B。医疗卫生技术工作

解析：《医疗机构管理条例》规定，医疗机构不得使用非卫生技术人员从事医疗卫生技术工作（B对）。医疗机构可以使用非卫生技术人员从事医疗后勤服务（A错）、医院安全保卫（C错）、医院财务审计（D错）、医疗器械采购（E错）等非医疗卫生技术工作。